预防气性坏疽的关键措施是
A. 纠正水电解质失调
B. 早期行筋膜切开减张
C. 早期应用抗生素
D. 应用高压氧
E. 尽早彻底清创

正确答案：E。尽早彻底清创

解析：气性坏疽多由厌氧菌感染所致，常见致病菌为梭状芽胞杆菌，常表现为肌肉坏死或肌炎，此类感染发展急剧，预后严重，所以早期预防显得尤为重要。预防的关键是尽早彻底清创（E对），包括清除失活、缺血的组织、去除异物、对深而不规则的伤口充分敞开引流。而纠正水电解质失调（A错）、早期行筋膜切开减张（B错）、早期应用抗生素（C错）及应用高压氧（D错）为支持、治疗措施，对于预防厌氧菌感染意义不大，不是外伤患者预防气性坏疽的关键。